Kennedy第一类缺失中混合支持式义齿设计要点不正确的是
A. 控制游离鞍基垂直向移动
B. 避免基牙受到扭力
C. 保护牙槽嵴健康
D. 加大基牙的负荷
E. 控制游离鞍基侧向移动

正确答案：D。加大基牙的负荷

解析：混合支持式义齿：此种设计适宜于双侧后牙部分或全部缺失、余留牙健康的情况下。设计要点：控制游离鞍基移动（垂直向、侧向），减轻或避免基牙受到扭力，保护牙槽嵴健康；减小基牙的负荷。掌握“局部义齿的设计”知识点。